PaCO₂升高时引起呼吸加深加快，接受刺激的主要部位是
A. 主动脉体和颈动脉体
B. 颈动脉体和主动脉弓
C. 颈动脉窦和主动脉体
D. 主动脉弓和颈动脉窦
E. 中枢化学感受器

正确答案：E。中枢化学感受器